下列对膳食纤维描述错误的是
A. 可降低胆固醇
B. 具有通便防癌的作用
C. 可降低餐后血糖
D. 具有结合阳离子的作用
E. 供给能量

正确答案：E。供给能量